关节内强直与关节外强直最有诊断意义的鉴别点是
A. 开口困难
B. 髁状突活动减弱或消失
C. （牙合）关系变化
D. 口腔颌面部畸形
E. X线片下正常解剖形态的变化或消失

正确答案：E。X线片下正常解剖形态的变化或消失

解析：本题考查关节内强直与关节外强直的鉴别诊断要点。关节外强直X线片检查，在许勒位片上，髁突、关节窝和关节间隙清晰可见；纤维性关节内强直表现为关节正常解剖形态消失，骨性关节内强直表现为关节间隙消失，髁突和关节窝融合成很大的致密团块，呈骨球状，故X线片下正常解剖形态的变化或消失（E对）是关节内强直与关节外强直最有意义的鉴别点。关节内强直与关节外强直均存在开口困难（A错）、髁状突活动减弱或消失（B错）、（牙合）关系的变化（C错）及口腔颌面部的畸形（D错）的临床表现，不能以这些共同的临床表现作为鉴别点。